某男，65岁。哮喘10余年，气短乏力，痰多清稀，食纳减少，腹胀便溏，足面浮肿。舌淡苔白，脉细弱。中医辨证是
A. 肾不纳气
B. 肺肾阴虚
C. 心肾阳虚
D. 心肺两虚
E. 肺脾两虚

正确答案：E。肺脾两虚

解析：本题考查的是肺脾两虚证的临床表现。哮喘10余年，气短乏力，痰多清稀，食纳减少，腹胀便溏，足面浮肿。舌淡苔白，脉细弱。中医辨证是肺脾两虚（E对）。肺脾两虚证的临床表现，常见久咳不已，短气乏力，痰多清稀，食纳减少，腹胀便溏，甚则足面浮肿，舌淡苔白，脉细弱。肾不纳气（A错）证的临床表现，常见气虚喘促，呼多吸少，动则喘甚，汗出，四肢不温，恶风寒，面部虚浮，舌质淡，脉虚弱。肺肾阴虚（B错）证的临床表现，常见咳嗽痰少，动则气促，间或咯血，腰膝酸软，消瘦，骨蒸潮热，盗汗遗精，颧红，舌红苔少，脉细数。心肺两虚（D错）证的临床表现，常见久咳不已，气短心悸，面色白，甚者可见口唇青紫，舌淡，脉细弱。心肾阳虚（C错）证的临床表现，2022年考试指南未明确说明。